主要学科的专家一般不得少于鉴定组成员的二分之一遵循了
A. 回避原则
B. 公正原则
C. 合议制原则
D. 医学会原则
E. 独立鉴定原则

正确答案：C。合议制原则

解析：合议制原则:专家鉴定组进行医疗事故技术鉴定，实行合议制。专家鉴定组人数应当为单数，涉及的主要学科的专家一般不得少于鉴定组成员的二分之一；涉及死因、伤残等级鉴定的，并应当从专家库中随机抽取法医参加专家鉴定组。掌握“医疗事故的技术鉴定”知识点。